下列关于牙本质过敏症治疗的论述中，错误的是
A. 牙本质过敏症可以自愈，不必治疗
B. （牙合）面的过敏点可用麝香草酚脱敏
C. 牙颈部可用NaF脱敏
D. 较局限的敏感区，可作充填治疗
E. 对牙本质过敏的有效治疗必须封闭牙本质小管

正确答案：A。牙本质过敏症可以自愈，不必治疗

解析：本题考查牙本质过敏症的治疗。牙本质过敏症若不及时治疗，使刺激长时间作用于牙髓，可引发牙髓炎症甚至牙髓坏死（A错，为本题的正确答案）。对于（牙合）面的过敏点可用麝香草酚脱敏，通过麝香草酚透热法，堵塞牙本质小管，达到脱敏的效果（B对）。牙颈部可用NaF脱敏，氟离子有机械阻塞作用，可减少牙本质小管的直径，达到脱敏的效果（C对）。对于较局限的敏感区，可作充填治疗，通过充填的方法隔离敏感区并封闭牙本质小管，可起到良好的脱敏效果（D对）。牙本质小管可传导刺激至牙髓，从而引起牙髓的反应；对于牙本质过敏的有效治疗必须封闭牙本质小管，以隔绝外界刺激（E对）。